可用地塞米松治疗的疾病有
A. 慢性肾上腺皮质功能不全
B. 心功能不全
C. 类风湿关节炎
D. 感染中毒性休克
E. 支气管哮喘

正确答案：A、C、D、E。慢性肾上腺皮质功能不全；类风湿关节炎；感染中毒性休克；支气管哮喘

解析：本题考查地塞米松的临床作用。地塞米松主要用于急、慢性肾上腺皮质功能减退症（A对），抗感染、抗过敏、如感染中毒性休克（D对）、活动性风湿病、类风湿关节炎（C对）和全身性红斑狼疮等结缔组织疾病，严重支气管哮喘（E对）、皮炎等各种过敏性疾病，以及急性白血病等的治疗。不能用于心功能不全（B错）的治疗。